原发性甲状腺功能减退症血中升高的是
A. TT₃
B. FT₃
C. TRAb
D. rT₃
E. TSH

正确答案：E。TSH

解析：原发性甲状腺功能减退时，由于甲状腺腺体本身病变，引起分泌至血中的甲状腺激素减少。甲状腺激素（T₃、T₄）分泌减少，对于下丘脑（TRH）—腺垂体（TSH）—甲状腺轴（T₃、T₄）的负反馈抑制作用减弱，导致血TSH升高（E对）。T₃主要来源于外周组织中T₄的转换，T4分泌减少，所以血中TT₃（总三碘甲腺原氨酸）（A错）、FT₃（游离三碘甲腺原氨酸）（B错）降低。TRAb（促甲状腺激素受体抗体）（C错）包括刺激性（TSAb）和抑制性（TSBAb）两种抗体，主要作为鉴别甲亢病因、诊断GD的重要指标。rT₃（D错）主要由周围组织中T₄转化而来，正常人血中含量极少，甲减时rT₃亦减少。rT₃增高主要见于低T₃综合征（P690）。